患者女性，22岁，9年前左上中切牙因外伤脱落，当时行即刻再植手术，现检查发现该牙无松动、叩痛，根尖片见牙根与牙槽骨直接相连，牙周膜消失，该牙再植后的愈合方式是
A. 牙周膜愈合
B. 一期愈合
C. 骨性愈合
D. 纤维性愈合
E. 暂时性愈合

正确答案：C。骨性愈合

解析：该牙再植后9年未松动脱落，跟尖片见牙周膜消失，牙根与牙槽骨直接连接，提示其愈合方式为骨性愈合。故答案为C。掌握“牙槽外科”知识点。